患者女，62岁，2型糖尿病伴下肢浮肿、活动后呼吸困难，不宜选用的药物是
A. 二甲双胍
B. 吡格列酮
C. 阿卡波糖
D. 格列齐特
E. 西格列汀

正确答案：B。吡格列酮

解析：本题考查吡格列酮。由题干可知该患者下肢浮肿，活动后呼吸困难，不宜选用吡格列酮（B错，为本题正确答案）用于糖尿病的治疗，因为吡格列酮的不良反应有头痛、肌痛、上呼吸道感染、水肿。二甲双胍（A对）的不良反应有恶心、呕吐、腹泻、味觉异常等。阿卡波糖（C对）的不良反应有胃肠胀气和肠鸣音。格列齐特（D对）的不良反应有头痛，极度饥饿，恶心，呕吐，倦怠，倦睡，睡眠障碍，激动，攻击性行为等。西格列汀（E对）的不良反应有过敏反应、血管性水肿、皮疹、荨麻疹、皮肤血管炎以及剥脱性皮肤损害。